外感热病极期多见舌质
A. 淡白舌
B. 淡红舌
C. 红舌
D. 青紫舌
E. 绛舌

正确答案：E。绛舌

解析：本题考查的是望舌色。外感热病极期多见舌质绛舌（E对）。望舌色：主要观察舌质颜色的异常变化，主要有以下四种。①淡白舌（A错）：较正常舌色浅淡，称为淡白舌。主虚寒证，为阳气虚弱、气血不足之象。阳虚血少，气血不荣，故舌色淡白，常见于阳虚、血虚的病证。②红舌（C错）：舌色深于正常舌，称为红舌。主热证。热盛则气血涌甚，反映于舌质，故呈现红色。可见于里实热证，也可见于阴虚内热。③绛舌：舌色深红，称为绛舌。主内热深重。外感热病见绛舌，表示邪热深入营血，多见于热性病极期。内伤杂病中，绛舌常见于久病、重病之人，多属阴虚火旺。④紫舌（D错）：舌见紫色，主病有寒热之分，绛紫色深，干枯少津，多系邪热炽盛、阴液两伤、血气壅滞不畅之象；淡紫或青紫温润，多因阴寒内盛、血脉瘀滞所致。舌上有紫色斑点，称为瘀斑或瘀点，多为血瘀之象。淡红舌（B错）为正常舌色。